医学伦理学的基本观点有
A. 健康观、生命观和人道观
B. 死亡观、价值观和利益观
C. 健康观、生命观和政治观
D. 健康观、生命观、死亡观
E. 死亡观、价值观和文化观

正确答案：D。健康观、生命观、死亡观

解析：医学伦理学的基本观点有健康观、生命观、死亡观。掌握“医学伦理学”知识点。